浦肯野细胞动作电位0期去极化是由于
A. Cl-内流
B. Ca2+内流
C. Na+内流
D. K+内流
E. K+外流

正确答案：C。Na+内流

解析：浦肯野细胞为快反应自律细胞，其动作电位的形状与心室肌动作电位相似，也分为0期、1期、2期、3期和4期五个时相，0～3期的产生机制也与心室肌细胞基本相同。因此其动作电位0期去极化是由于Na⁺内流（C对）（INa）而引起，去极化的速度甚至比心室肌细胞还要高。